氮氧化物与挥发性有机物在日光下生成的二次污染是
A. 硝酸盐
B. 酸雨
C. 水体富营养化
D. 甲基汞
E. 光化学烟雾

正确答案：E。光化学烟雾

解析：氮氧化物（NOX）和挥发性有机物（VOCS）在强烈日光紫外线照射下，经过一系列光化学反应生成光化学烟雾（E对）。酸雨（B错）（P286）是由大气中SO₂、NOX等污染物溶于水汽中，经过氧化、凝结而成。水体富营养化（C错）是受含磷、氟等污水污染造成的。甲基汞（D错）是由溶解度很小的无机汞在环境微生物的作用下能转化而成，甲基汞的溶解度和吸收性及对健康的危害远远高于无机汞。硝酸盐（A错）是含氮有机物经无机化作用分解的最终产物。